男性，56岁。活动后气急5年，轻微咳嗽，咳少量黏液痰。体检：呼吸急促，双肺叩诊呈过清音，呼吸音减弱，无啰音。X线胸片显示双肺野透亮度增加，膈肌低平。该病例诊断应为
A. 慢性支气管炎
B. 支气管哮喘
C. 慢性肺源性心脏病
D. 慢性阻塞性肺疾病（气肿型）
E. 慢性阻塞性肺疾病（支气管炎型）

正确答案：D。慢性阻塞性肺疾病（气肿型）

解析：患者为老年男性，活动后气急5年，轻微咳嗽，咳少量粘液痰（为慢性支气管炎的典型表现），考虑诊断为慢性支气管炎。体检见呼吸急促，双肺叩诊呈过清音，呼吸音减弱，无啰音，X线胸片显示双肺野透亮度增加，膈肌低平，考虑已经由慢性支气管炎发展到了慢性阻塞性肺疾病（气肿型）（D对）。患者主要表现为肺气肿，轻微咳嗽，不符合慢性阻塞性肺疾病（支气管炎型）（该型以咳嗽症状为主）的诊断（E错）。慢性支气管炎（P20）（A错）指尚未出现持续气流受限的，表现为每年咳嗽咳痰3月以上，持续≥2年的支气管炎，患者已经有肺气肿的表现，故与本病例中患者表现不符。支气管哮喘（P29）（B错）多有反复发作性、喘息、气急、胸闷咳嗽，发作时双肺闻及弥漫性哮鸣音等表现，其气流受限为可逆性的，与本病例表现不符。慢性肺源性心脏病（P110-P111）（C错）多有P₂＞A₂，颈静脉充盈甚至怒张，右心肥厚等表现，与本病例不符。